男，50岁。因突发持续胸痛8小时，喘憋2小时入院。既往无高血压病史。查体：BP150/70mmHg，端坐位，双肺可闻及少许细湿啰音，心界不大，心率110次/分，率齐，P₂＞A₂。心电图示I、aVL、V1～V6导联ST段抬高0.1～0.4MV。可见病理性Q波。该患者应慎用的药物治疗为
A. 皮下注射吗啡
B. 静脉注射毛花苷丙
C. 口服阿司匹林
D. 静脉注射硝酸甘油
E. 静脉注射呋塞米

正确答案：B。静脉注射毛花苷丙

解析：中年男性患者，持续胸痛8小时。喘憋2小时入院（心梗表现）。双肺可闻及少许细湿啰音（急性肺水肿体征），心电图示I、aVL、V1～V6导联ST段抬高0.1~0.4MV。可见病理性Q波（心梗的特征性表现），故诊断为急性ST段抬高性心肌梗死，心梗患者一般容易发生洋地黄中毒，故应当慎用毛花苷丙（B对）。皮下注射吗啡为心梗时的镇静作用（A错）。口服阿司匹林为心梗的抗血小板治疗（C错）。静脉注射硝酸甘油通过扩张冠状动脉、增加冠状动脉血流量以及增加静脉容量而降低心室前负荷（D错）。静脉注射呋塞米（利尿剂）一般用于治疗单纯性收缩期高血压（E错）。